根据下列血气分析结果，判断酸碱失衡的类型:PH:7.46，PaCO₂：29mmHgHCO₃⁻：20mmol/L
A. 代谢性酸中毒
B. 呼吸性酸中毒
C. 代谢性碱中毒
D. 呼吸性碱中毒
E. 酸碱平衡正常

正确答案：D。呼吸性碱中毒

解析：判断酸碱失衡的类型先判断PH后判断原发性紊乱：PH>7.35则为碱中毒，患者PaCO₂（正常范围为33~46 mmHg），HCO₃⁻（正常为22~27 mmoI/L）均下降，如果原发HCO₃⁻下降，PH值也应下降，所以原发性因素是PaCO₂下降，导致PH上升而发生呼吸性碱中毒（D对）。